前列腺增生病气滞血瘀证，应首选
A. 沉香散
B. 八正散
C. 补中益气汤
D. 济生肾气丸
E. 知柏地黄丸

正确答案：A。沉香散

解析：前列腺增生病气滞血瘀证治宜行气活血，通窍利尿，方用沉香散加减（A对）。八正散（B错）清热利湿，适用于前列腺增生病湿热下注证；补中益气汤（C错）补脾益气，适用于前列腺增生病脾肾气虚证；济生肾气丸（D错）温补肾阳，适用于前列腺增生病肾阳不足证；知柏地黄丸（E错）滋补肾阴，适用于前列腺增生病肾阴亏虚证。